女性，22岁。2年来反复痰中带血，期间有大口咯血。体格检查无异常体征，X线胸片示左下肺纹理增粗、紊乱。最可能的诊断是
A. 风心病二尖瓣狭窄
B. 慢性支气管炎
C. 支气管扩张症
D. 支气管肺癌
E. 肺结核

正确答案：C。支气管扩张症

解析：患者青年女性，近两年来反痰中带血，期间有大口咯血（支气管扩张症约50～70%发生咯血），体格检查无异常体征，X线胸片示左下肺纹理增粗、紊乱（支气管扩张症早期表现），最可能的诊断是支气管扩张症（C对）。风心病二尖瓣狭窄（P299）（A错）常有呼吸困难表现，查体见二尖瓣面容，听诊心尖区有舒张期隆隆样杂音，X线提示左心房增大。慢性支气管炎（P20）（B错）主要表现为慢性咳嗽、咳痰，或伴有喘息，极少发生咯血。支气管肺癌（P78）（D错）主要表现为无痰或少痰的刺激性干咳，或有痰血或咯血，X线胸片常见孤立圆形病灶和单侧性肺门阴影增大。肺结核（P64）（E错）主要表现为午后低热、盗汗、疲乏无力、体重减轻等，X线胸片见病变多在肺尖或锁骨下。